人体之精的功能不包括的有
A. 濡养
B. 繁衍
C. 化神
D. 温煦
E. 化气血

正确答案：D。温煦

解析：精主闭藏而静谧于内，与气之运行不息相较，其性属阴。精除了具有繁衍生命（B对）、濡养（A对）、化血、化气（E对）、化神（C对）、抗邪等功能。气具有温煦作用而精没有此功能（D错，为本题正确答案）。